下列除哪项外，均可见胸痛
A. 带状疱疹
B. 肺癌
C. 气胸
D. 心包炎
E. 哮喘

正确答案：E。哮喘

解析：胸痛是临床上常见的症状，主要由胸部疾病所致，少数由其他疾病引起。胸壁疾病如带状疱疹（A对）、呼吸系统疾病如气胸（C对）、肺癌（B对）、心血管疾病如心包炎（D对）等均可以引起胸痛。哮喘（E错，为本题正确答案）常见症状为气短、喘息等呼吸困难的症状，一般不会出现胸痛。